捏脊疗法的治疗经脉是
A. 肾经、膀胱经
B. 任脉
C. 督脉、膀胱经
D. 带脉
E. 肺经

正确答案：C。督脉、膀胱经

解析：捏脊疗法是通过对督脉和膀胱经的捏拿，调整阴阳、通理经络、调和气血、恢复脏腑功能以防治疾病的一种疗法，临床常用于治疗小儿疳积、消化不良、厌食、腹泻、呕吐、便秘、咳喘、夜啼、遗尿等症（C对）。